根据传染病学防治法，SARS的管理应
A. 按甲类管理
B. 按乙类管理
C. 按丙类管理
D. 各级医疗机构自行决定
E. 各省级卫生管理机构自行决定

正确答案：A。按甲类管理

解析：《中华人民共和国传染病防治法》将SARS列入法定传染病种的乙类，但按甲类传染病进行管理（A对）。